中药材浸提过程中的主要推动力是
A. 扩散系数
B. 扩散时间
C. 浸提温度
D. 液体粘度
E. 浓度梯度

正确答案：E。浓度梯度